正常人血清中含量最少的抗体是
A. IgG
B. IgM
C. IgD
D. IgE
E. IgA

正确答案：D。IgE